发生医院感染时的管理措施不包括
A. 医学观察
B. 封锁疫情
C. 隔离患者
D. 检查病原携带者
E. 开展流行病学调查

正确答案：B。封锁疫情